简要记录患者发病后的精神状态、睡眠等情况应为
A. 发病情况
B. 伴随症状
C. 发病以来诊治经过及结果
D. 发病以来一般情况
E. 主要症状特点及其发展变化情况

正确答案：D。发病以来一般情况

解析：发病以来一般情况：简要记录患者发病后的精神状态、睡眠、食欲、大小便、体重等情况。掌握“口外病史记录”知识点。